关于药品生产、经营企业禁止性经营活动的说法，正确的有
A. 药品生产、经营企业不得以买药品赠药品，买商品赠药品的方式向公众赠送处方药
B. 药品生产、经营企业不得为他人以本企业的名义经营药品提供场所，或者资质证明文件，或者票据
C. 药品经营企业应按照许可的经营范围经营药品，不得采用邮售方式直接向公众销售处方药
D. 药品生产企业只能销售本企业生产和接受委托生产的药品，不得销售他人生产的药品

正确答案：A、B。药品生产、经营企业不得以买药品赠药品，买商品赠药品的方式向公众赠送处方药；药品生产、经营企业不得为他人以本企业的名义经营药品提供场所，或者资质证明文件，或者票据

解析：本题考查的是药品批发企业的禁止类行为。关于药品生产、经营企业禁止性经营活动的说法，正确的有药品生产、经营企业不得以买药品赠药品，买商品赠药品的方式向公众赠送处方药（A对）；药品生产、经营企业不得为他人以本企业的名义经营药品提供场所，或者资质证明文件，或者票据（B对）。药品批发企业的禁止类行为：药品批发企业在从事药品经营活动中，应当遵循“诚实守信、依法经营”的原则，禁止以任何弄虚作假手段骗取药品经营许可证，尤其是禁止采用聘用“挂证”执业药师骗取药品经营许可证。药品批发企业不得违法回收或参与回收药品，销售回收药品；不得为他人违法经营药品提供场所、资质证明文件、票据等条件；不得接受药品上市许可持有人委托销售后，再次委托销售；不得从非药品上市许可持有人、药品批发企业等单位或个人处购进药品；不得向无合法购药资质的单位或者个人销售药品，尤其是知道或者应当知道他人从事无证经营仍为其提供药品；不得以中药材及初加工产品冒充中药饮片销售，非法加工中药饮片；不得委托不符合药品GSP的企业储存运输药品；不得伪造药品采购来源，虚构药品销售流向，篡改计算机系统、温湿度监测系统数据，隐瞒真实药品购销存记录、票据、凭证、数据等，致使药品购销存记录不完整、不真实，经营行为无法追溯；不得在证、票、账、货、款不能相互对应一致时购销药品；不得有药品未入库，设立账外账，药品未纳入企业质量体系管理，使用银行个人账户进行业务往来等情形；不得将麻醉药品、精神药品和含特殊药品复方制剂流入非法渠道，或者进行现金交易；不得购进销售医疗机构制剂；不得在核准地址以外的场所储存药品；不得违反规定对药品储存、运输及进行温湿度监测；不得擅自改变药品经营许可证许可事项、登记事项；不得以展销会、博览会、交易会、订货会、产品宣传会等方式现货销售药品或赠送药品；不得不经药品零售连锁总部，直接向药品零售连锁企业门店销售药品；不得向药品零售企业销售禁止零售的药品；不得向非连锁药品零售企业销售第二类精神药品；不得销售药品不开具发票。药品上市许可持有人可授权派出医药代表从事学术推广、技术咨询等活动，但不得要求其承担药品销售任务。疫苗上市许可持有人不得向除疾病预防控制机构外的其他任何单位或个人销售疫苗。药品网络销售者应当是取得药品上市许可持有人、药品经营企业（D错）。其他企业、机构及个人不得从事药品网络销售，法律法规另有规定的除外。药品网络销售范围不得超出药品持有、药品经营许可范围（C错）。药品网络销售者为药品上市许可持有人、药品批发企业的，不得向个人消费者销售药品。药品网络销售者为药品零售企业的，不得通过网络销售含麻黄碱类复方制剂等国家有专门管理要求的药品。